某些慢性疾病使用波尼松长期治疗，为减少外源性激素对小丘脑-垂体-肾上腺皮质轴的抑制，推荐的给药时间是
A. 上午8时左右
B. 中午12时左右
C. 下午4时左右
D. 晚餐前
E. 睡前

正确答案：A。上午8时左右

解析：本题考查泼尼松的给药时间。某些慢性疾病使用波尼松长期治疗，为减少外源性激素对小丘脑-垂体-肾上腺皮质轴的抑制，推荐的给药时间是上午8时左右（A对）。泼尼松为常用的糖皮质激素。糖皮质激素的使用方法包括大剂量冲击疗法和一般剂量长期疗法。一般剂量长期疗法用于结缔组织病、肾病综合征、顽固性支气管哮喘等。一般开始用波尼松10～20mg或等效的其它糖皮质激素，一日3次。产生疗效后，逐渐减至最小维持量，持续数月。对于已用糖皮质激素控制的某些慢性病，可改用隔日给药，即把48小时用量，在早晨8时一次服用，这样对下丘脑、垂体、肾上腺皮质抑制较轻，不良反应较少。隔日服药以波尼松、波尼松龙较好。